月经周期为28天有排卵的妇女，于月经周期第11天刮宫，镜检子宫内膜应为
A. 增生期中期
B. 增生期晚期
C. 分泌期早期
D. 分泌期中期
E. 分泌期晚期

正确答案：B。增生期晚期

解析：根据子宫内膜的组织学变化将月经周期分为月经期（1～4日）、增殖早期（5～7日）、增殖中期（8～10日）、增殖晚期（11～14日）、分泌早期（15～19日）、分泌中期（20～23日）、分泌晚期（24～28日）。月经周期为28天有排卵的妇女，于月经周期第11天刮宫，镜检子宫内膜应为增生期晚期（B对）。